气随血脱的生理基础是
A. 气能生血
B. 气能摄血
C. 气能行血
D. 血能载气
E. 血能生气

正确答案：D。血能载气

解析：气能生血是指血液的生成必须依赖着气的推动作用和气化作用。血虚时，常配以补气药，加强补血的效果即该理论的应用（A错）。气能摄血是指血液的正常运行必须依赖着气的固摄作用。常在治疗气虚引起的出血时配伍补气药，达到止血的目的（B错）。气能行血是指血液的正常运行必须依靠着气的推动作用，该理论常用于气虚血瘀、气滞血瘀、血随气逆证的治疗（C错）。血能载气是指无形之气必须依附于有形之血中，并受血液的滋养才不会散失，因此临床上大出血时会出现气的大量丢失，称之为气随血脱（D对）。血能生气指气的充盛及其功能发挥离不开血液的濡养（E错）。